胎儿附属物的描述错误的是
A. 胎膜由绒毛膜和羊膜组成
B. 脐带长平均约55cm
C. 脐带是母儿间物质交换的通道
D. 脐带断面中央有两条脐静脉
E. 脐带直径0.8～2.0cm

正确答案：D。脐带断面中央有两条脐静脉

解析：脐带断面中央有一条脐静脉，两侧有两条脐动脉。掌握“妊娠生理”知识点。